组织构造中有树脂道的药材有
A. 桔梗
B. 人参
C. 当归
D. 三七
E. 西洋参

正确答案：B、D、E。人参；三七；西洋参

解析：本题考查的是饮片的断面特征。组织构造中有树脂道的药材有人参（B对）、三七（D对）、西洋参（E对）。分泌组织在切面上也是重要的鉴别特征，如人参、三七、西洋参具树脂道，饮片皮部具棕黄色小点；苍术具大型油室，饮片显“朱砂点”；鸡血藤具分泌细胞，饮片皮部有树脂样红棕色分泌物等。黄芪、板蓝根、桔梗（A错）饮片切面皮部白色，木部黄色，习称“金井玉栏”。当归（C错）切面黄白色或淡棕黄色，平坦，有裂隙，中间有淡棕色形成层环，并有多数棕色油点，质柔韧。